维生素D缺乏性佝偻病可靠的早期诊断指标是
A. 血清钙浓度降低
B. 血清磷浓度降低
C. 血清碱性磷酸酶增高
D. 血1，25-（OH）₂D3降低
E. 血PTH降低

正确答案：D。血1，25-（OH）₂D3降低

解析：VitD包括VitD₂和VitD ₃ ，食物中的VitD₂经肠道吸收入血，皮肤合成的VitD3直接吸收入血。吸收入血的VitD₂、VitD₃ 与血浆中的VitD结合蛋白（DBP）结合运送至肝脏，在肝25-羟化酶作用下生成25-（OH）D₃ ，后者在肾1α-羧化酶作用下转变为1，25-（OH）₂D₃ 。其中，VitD2、VitD3在体内没有生物活性；25-（OH）D₃ 是血液循环中VitD的主要形式，但生理活动较弱；1，25-（OH）₂D₃是VitD在体内的主要活动活性形式。维生素D缺乏性佝偻病可以看成是可表现为血清VitD、25-（OH）D₃、1，25-（OH）₂D₃均降低，但由于血清25-（OH）D₃是是血循环中VitD的主要以形式，因此，血清25-（OH）D₃（而不是1，25-（OH）₂D₃）水平降低是维生素D缺乏病最可靠的诊断指标，可见答案项D并不严谨。长期维生素D缺乏会造成肠道吸收钙、磷减少和低钙血症（AB错），以致甲状旁腺功能代偿性亢进，PTH分泌增加（E错）以动员骨钙释放可有血钙血磷降低，以维持血钙相对平衡；另外，碱性磷酸酶分泌增加（C错），但都不是早期可靠的诊断指标。